男，45岁。右上腹胀痛伴间断发热4个月。1年前曾因“菌痢？”住院治疗后缓解。曾于粪便中发现叶状伪足的滋养体。腹部B超示右叶单发直径10cm嚢肿。此病原体从肠道感染至肝的途径是
A. 从腹腔经淋巴系统入肝
B. 从结肠经门静脉入肝
C. 从小肠经门静脉入肝
D. 从胆道上行入肝
E. 从胃经门静脉入肝

正确答案：B。从结肠经门静脉入肝

解析：患者右上腹胀痛伴间断发热，腹部B超示：肝右叶单发直径10cm囊肿，在粪便中发现叶状伪足的滋养体（阿米巴肝脓肿的主要诊断标准），应诊断为阿米巴性肝脓肿。阿米巴经口摄入后，经过胃后未被胃液杀死的包囊进入小肠下段，经胰蛋白酶作用脱囊而逸出4个滋养体，寄生于结肠腔内，侵入肠壁的溶组织内阿米巴滋养体在结肠道感染后，可经门静脉、淋巴管或直接蔓延侵入肝脏（B对）。